在中国药典中，硝苯地平的含量测定方法是
A. 重量法
B. 铈量法
C. 银量法
D. 亚硝酸钠滴定法
E. 非水溶液滴定法

正确答案：B。铈量法

解析：本题考查铈量法。在中国药典中，硝苯地平的含量测定方法是铈量法（B对）。铈量法是以四价铈离子溶液为标准溶液的氧化还原滴定方法，常用硫酸铈的硫酸溶液作滴定剂，以邻二氮菲为指示剂。由于不受制剂中淀粉、糖类的干扰，因此特别适合片剂、糖浆剂等制剂的测定。《中国药典》2005年版采用铈量法测定的药物有：硫酸亚铁片、硝苯地平等。重量法（A错）先分离、后称量测定含量。银量法（C错）是利用生成难溶性银盐来进行测定的方法。亚硝酸钠滴定法（Ｄ错）是利用芳伯氨基与亚硝酸钠发生重氮化反应来测定。非水溶液滴定法（E错）是以质子传递反应为基础的在水以外的溶剂中滴定的方法。